某女，56岁。近日出现气短心悸、失眠多梦、头昏头晕、肢倦乏力、食欲不振、崩漏便血等症。遂就医，医师诊断为心脾两虚，处以归脾丸。处方组成：党参80g、炒白术160g、炙黄芪80g、炙甘草40g、茯苓160g、制远志160g、炒酸枣仁80g、龙眼肉160g、当归160g、木香40g、大枣（去核）40g。以上十一味，党参、当归、炙甘草、木香粉碎成细粉，其余炒白术等七味，加水煎煮两次，合并煎液，滤过，浓缩得稠膏，与上述粉末混匀，制成浓缩水丸。为缓解苦燥之性，同时消除刺喉麻感，处方中制远志宜采用煮法炮制，使用的辅料是
A. 黑豆汁
B. 黄酒
C. 姜汁
D. 米醋
E. 甘草汁

正确答案：E。甘草汁

解析：本题考查远志的炮制作用。为了缓和苦燥之性，同时消除刺喉麻感，处方中制远志宜采用煮法炮制，使用的辅料是甘草汁（E对）。远志【炮制作用】远志味苦、辛，性温。归心、肾、肺经。具有安神益智，交通心肾，祛痰，消肿的功效。①生品“戟人咽喉”，多外用。用于痈疽肿毒，乳房肿痛。②制远志，以甘草汤制远志，既缓其苦燥之性，又能消除刺喉麻感，以安神益智为主。用于心悸，失眠，健忘，精神不安。③蜜炙后增强润肺化痰止咳的作用，用于寒痰咳逆，咳嗽痰多，咳吐不爽等。蒸制：利用水蒸气加热药物（或药物与辅料）的方法。不加辅料蒸制的时间较短，其目的是软化药材，便于切制或使药物便于保存，如清蒸木瓜、天麻、桑螵蛸、黄芩、人参等。加辅料蒸制的时间相对较长，主要目的在于改变药物性味，产生新的功能，扩大临床适用范围，如酒蒸地黄、大黄，黑豆汁（A错）蒸何首乌；亦可增强疗效，如酒蒸肉苁蓉、黄精、山茱萸、女贞子、五味子等。酒炙：将净选或切制后的药物，加入定量黄酒拌炒的方法称为酒炙法。黄酒（B错）味甘、辛，性大热。气味芳香，能升能散，宣行药势，具有活血通络、祛风散寒、矫臭去腥的作用。故酒炙法多用于活血散瘀药、祛风通络药及动物类中药。姜汁（C错）及其作用：姜汁为姜科植物鲜姜的根茎，经捣碎取的汁；或用干姜，加适量水共煎去渣而得的黄白色液体。姜汁有香气，其主要成分为挥发油、姜辣素（姜烯酮、姜酮、姜萜酮混合物），另外，尚含有多种氨基酸、淀粉及树脂状物。常以姜汁制的药物有厚朴、竹茹、草果、半夏、黄连、天麻、栀子等。醋及其作用：醋古称酢、醯、苦酒，习称米醋。古代传统的酒多为甜酒、浊酒，由于含醇浓度低，易酸败成醋，具有苦味，故醋又称苦酒。醋有米醋（D错）、麦醋、曲醋、化学醋等多种。《本草纲目》指出，制药用醋“惟米醋二三年者入药”。炮制用醋为食用醋（米醋或其他发酵醋），化学合成品（醋精）不应使用。醋长时间存放者，称为“陈醋”，陈醋用于药物炮制佳。醋多用作炙、蒸、煮等辅料，常用醋制的药物有延胡索、甘遂、商陆、大戟、芫花、三棱、莪术、香附、柴胡、郁金等。